琥珀具有的功效是
A. 养血安神
B. 润肠通便
C. 收敛固涩
D. 平肝潜阳
E. 活血散瘀

正确答案：E。活血散瘀

解析：琥珀具有镇惊安神，活血散瘀（E对），利尿通淋的功效，可用于痛经经闭，心腹刺痛，癥瘕积聚，本品入心、肝血分，有活血通经，散瘀消癥作用，治血瘀气阻之痛经经闭。